心指数等于
A. 心率×每搏输出量/体表面积
B. 每搏输出量×体表面积
C. 每搏输出量/体表面积
D. 心输出量×体表面积
E. 心率×每搏心输出量×体表面积

正确答案：A。心率×每搏输出量/体表面积